若在7岁之前居住地的饮水中氟含量高于1ppm，则会造成
A. 釉质钙化不全
B. 四环素牙
C. 牙本质形成不全
D. 遗传性乳光牙本质
E. 易龋齿

正确答案：A。釉质钙化不全

解析：氟牙症，又称斑釉牙、氟斑牙。在牙齿发育阶段，如果饮用水中氟含量高于1ppm，氟离子可导致釉质形成不全和钙化不全，这种釉质的发育障碍即为氟牙症。掌握“氟牙症、先天性梅毒牙与牙本质形成缺陷”知识点。